防风的功效是
A. 祛风解表，胜湿止痛，解痉
B. 祛风解表，止血
C. 解表散寒，祛风胜湿，止痛
D. 祛风湿，止痹痛，利水消肿
E. 祛风湿，止痹痛，通鼻窍

正确答案：A。祛风解表，胜湿止痛，解痉

解析：防风辛散微温，甘缓不峻，药力和缓，既入膀胱经，又入肝脾经。善祛风胜湿而发表、止痛、止痒、解痉，为治风通用药。无论外风、内风、风湿所致病证，也无论兼寒兼热，皆可投用。能祛风散寒，胜湿止痛，为较常用之祛风湿、止痹痛药。辛温发散，能祛风止痒，可以治疗多种皮肤病，其中尤以风邪所致之隐疹瘙痒较为常用。既能辛散外风，又能息内风以止痉（A对）。功效为祛风解表，止血（B错）的中药是荆芥，应注意荆芥生用解表散风，透疹消疮，炒炭之后才有收敛止血作用。功效为解表散寒，祛风胜湿，止痛（C错）的中药是羌活。功效为祛风湿，止痹痛，利水消肿（D错）的中药是防己。功效为祛风湿，止痹痛，通鼻窍（E错）的中药是苍耳子。